女，45岁。脸圆、变红1年，体重增加、月经稀发6个月。查体：BP160/100mmHg，向心性肥胖，皮肤薄，面部痤疮较多，下颌小胡须，全身毳毛增多，腹部、大腿根部可见宽大紫纹。血钾3.3mmol/L，空腹血糖15.4mmol/L。有助于了解其病因或病变部位的检查是
A. 大剂量地塞米松试验
B. OGTT
C. 小剂量地塞米松试验
D. 血皮质醇测定
E. 血醛固酮测定

正确答案：A。大剂量地塞米松试验

解析：患者脸圆变红，皮肤薄有痤疮，月经稀发，下颌小胡须，全身毳毛增多，血压偏高，向心性肥胖，腹部、大腿根部见宽大紫纹，低血钾（正常值3.5～5.5 mmol/L），高血糖（大于7.0mmol/L）等表现均提示库欣综合征。库欣综合征血浆皮质醇分泌增多，失去昼夜节律，且不能被小剂量地塞米松抑制（P700）。地塞米松为人工合成的糖皮质激素中生物作用最强的激素之一，仅需要很小的剂量即能达到与天然皮质醇相似的作用。使用小剂量（0.5mg）地塞米松可抑制正常人的皮质醇分泌，血皮质醇测定值减少，而库欣综合征却不受影响。因此小剂量地塞米松试验（C错）可用于诊断库欣综合征，但无法鉴别库欣综合征的病因。加大地塞米松剂量（2mg），可抑制库欣病腺垂体分泌ACTH，从而使血浆皮质醇浓度有所降低。但肾上腺皮质肿瘤由于可自主分泌皮质醇，因此血浆皮质醇浓度并不受影响。故大剂量地塞米松试验（A对）可用于鉴别肾上腺皮质肿瘤引起的库欣综合征与库欣病，因此可用于病因诊断。OGTT（B错）主要用于糖尿病的诊断。小剂量地塞米松抑制试验（C错）用于库欣综合征与正常人的鉴别诊断，小剂量地塞米松不能被抑制为不同病因引起库欣综合征的共同表现。血皮质醇（D错）增高亦为不同病因导致库欣综合征的共同表现。血醛固酮测定（E错）主要用于原发性醛固酮增多症的诊断。